可代替谷胱甘肽，用于对乙酰氨基酚中毒时解毒的药物是
A. 乙酰半胱氨酸
B. 盐酸氨溴索
C. 羧甲司坦
D. 磷酸苯丙哌林
E. 喷托维林

正确答案：A。乙酰半胱氨酸

解析：本题考查对乙酰氨基酚中毒解救药物。乙酰半胱氨酸（A对）属于半胱氨酸的类似物，可通过巯基与毒性代谢产物N-乙酰亚胺醌结合使其失活，阻止其与肝细胞的大分子共价结合而解毒。氨溴索（B错）是溴己新分子在体内的活性代谢物，不具有巯基，不能用于乙酰氨基酚中毒的解救。羧甲司坦（C错）为祛痰药，具有半胱氨酸的结构，但不具有游离的巯基，因此不能与毒性代谢产物结合而解毒。磷酸苯丙哌林（D错）和喷托维林（E错）结构中都不含有巯基，不能用于乙酰氨基酚中毒的解救。